属于惰性淋巴瘤的是
A. 边缘区淋巴瘤
B. 间变性大细胞淋巴瘤
C. Burkitt淋巴瘤
D. 弥漫性大B细胞淋巴瘤
E. 套细胞淋巴瘤

正确答案：A。边缘区淋巴瘤

解析：属于惰性淋巴瘤的是边缘区淋巴瘤（A对），属于B细胞惰性淋巴瘤。间变性大细胞淋巴瘤（B错）属于T细胞侵袭性淋巴瘤。Burkitt淋巴瘤（C错）、弥漫性大B细胞淋巴瘤（D错）、套细胞淋巴瘤（E错）都属于B细胞侵袭性淋巴瘤。